厚朴的炮制宜选用
A. 酒炙法
B. 醋炙法
C. 盐炙法
D. 姜炙法
E. 蜜炙法

正确答案：D。姜炙法

解析：本题考查的是姜炙法。厚朴的炮制宜选用姜炙法（D对）。姜炙法：将净选或切制后的药物，加入定量姜汁拌炒的方法。姜炙的目的：①制其寒性，增强和胃止呕作用。如黄连、竹茹等。②缓和副作用，增强疗效。如厚朴等。酒炙法（A错）：将净选或切制后的药物，加入定量黄酒拌炒的方法。酒炙的目的：①改变药性，引药上行，如大黄、黄连、黄柏等。②增强活血通络作用，如当归、川芎、桑枝等。③矫臭去腥，如乌梢蛇、蕲蛇、紫河车等。醋炙法（B错）：将净选或切制后的药物，加入定量米醋拌炒至规定程度的方法。醋炙的主要目的：①降低毒性，缓和药性。如甘遂、京大戟、芫花、商陆等。②引药入肝，增强活血止痛作用。如乳香、没药、三棱、莪术等。③矫臭矫味。如乳香、没药、五灵脂等。盐炙法（C错）：将净选或切制后的药物，加入定量食盐水溶液拌炒的方法。盐炙法的主要目的：①引药下行，增强疗效。如杜仲、小茴香、车前子、益智仁、知母、黄柏等。②缓和药物辛燥之性。如补骨脂、益智仁等。③增强滋阴降火作用。如知母、黄柏等。蜜炙法（E错）是将净选或切制后的药物，加入定量熟蜜拌炒的方法。蜜炙的主要目的：①增强润肺止咳的作用，如百部、款冬花、紫菀等。②增强补脾益气的作用，如黄芪、甘草、党参等。③缓和药性。如麻黄等。④矫味和消除副作用，如马兜铃等。